哪项不是天气与气候对健康的影响方式
A. 影响人体生理和代谢功能
B. 对生物性病原体和生物性传媒的影响
C. 影响污染物的吸收
D. 对人体的物理作用
E. 影响环境质量

正确答案：C。影响污染物的吸收

解析：本题考查天气与气候对健康的影响方式。天气与气候对健康的影响方式有：1.对人体的物理作用（D对）。例如：严寒造成冻疮或冻僵；环境高温引起热病或热促疾病；2.影响人体生理和代谢功能（A对）。气温能影响脑垂体、甲状腺、肾上腺和胰腺的分泌功能；3.对生物性病原体和生物性传媒的影响（B对）；4.影响环境质量（E对），增加环境污染物对健康的不良影响；5.对人体心理和精神状态的影响。天气与气候不会影响污染物的吸收（C错，为本题正确答案）。